病变同侧水平以下痉挛性瘫痪、本体感觉及精细触觉消失，而且对侧痛温觉消失，应考虑
A. 脊髓白质前连合损伤
B. 脊髓后索损伤
C. 脊髓侧索损伤
D. 脊髓前索损伤
E. 脊髓半侧损伤

正确答案：E。脊髓半侧损伤

解析：脊髓半侧损伤（E对）导致皮质脊髓束被阻断，表现为同侧水平以下痉挛性瘫痪、本体感觉及精细触觉消失，而且对侧痛温觉消失。